通过抑制黄嘌呤氧化酶减少尿酸生成的抗痛风药物是
A. 秋水仙碱
B. 丙磺舒
C. 别嘌呤
D. 苯溴马隆
E. 布洛芬

正确答案：C。别嘌呤

解析：本题考查别嘌呤。别嘌醇（C对）可抑制黄嘌呤氧化酶，使次黄嘌呤及黄嘌呤不能转化为尿酸，即尿酸合成减少，进而降低血中尿酸浓度，减少尿酸盐在骨、关节及肾脏的沉着。秋水仙碱（A错）为一种天然产物，通过减低白细胞活动和吞噬作用及减少乳酸形成从而减少尿酸结晶的沉积，减轻炎性反应，而起止痛作用。丙磺舒（B错）抑制肾小管对水的重吸收作用，增加尿液的排泄，降低尿酸在血液中的含量，也可促进已形成的尿酸盐的溶解，无抗炎和镇痛作用，临床用于慢性痛风的治疗。苯溴马隆（D错）通过抑制肾小管对尿酸的重吸收,从而降低血中尿酸的浓度。布洛芬（E错）为芳基丙酸类非甾体抗炎药。